男婴，11个月，发热4天，皮疹1天。体温波动在39～40℃，伴发热，咳嗽，声撕。查体：颜面，躯干可见红色斑丘疹，结膜充血，口腔黏膜充血且粗糙，可见细小白点，双肺闻及少量干啰音。对该病治疗不正确的是
A. 补充维生素A
B. 高热可给与退热药物
C. 静脉糖皮质激素
D. 呼吸道管理
E. 躁狂可给与镇静药物

正确答案：C。静脉糖皮质激素

解析：麻疹没有特异性治疗方法，注意皮肤和眼、鼻（D对）、口腔清洁，鼓励多饮水，给予易消化和营养丰富的食物，对症治疗高热时可酌情使用退热剂（B对），但应避免急骤退热，特别是在出疹期。烦躁可适当给予镇静剂（E对）频繁剧咳可用镇咳剂或雾化吸 WHO 推荐给予麻疹患儿补充大剂量维生素A（A对）,20万～40万单位，每日一次口服，连服剂可减少并发症的发生，有利于疾病的恢复。并发症的治疗有并发症者给予相应治疗，继发细菌感染可给予抗生素。糖皮质激素可以抑制免疫，所以要禁用于抗菌素不能治疗的感染，如水痘、麻疹、霉菌等感染（C错，为本题正确答案）。